医师对同一个患者申请一天备血达到或超过一定数量时，必须报医院医务部门批准，该血量是
A. 2000毫升
B. 1600毫升
C. 800毫升
D. 1000毫升
E. 1200毫升

正确答案：B。1600毫升

解析：本题考查临床用血申请。医师对同一个患者申请一天备血达到或超过一定数量时，必须报医院医务部门批准，该血量是1600毫升（B对ACDE错）。临床用血申请：医疗机构应当建立临床用血申请管理制度：①同一患者一天申请备血量少于800毫升的，由具有中级以上专业技术职务任职资格的医师提出申请，上级医师核准签发后，方可备血；②向一患者一天申请备血量在800毫升至1600毫升的，由具有中级以上专业技术职务任职资格的医师提出申请，经上级医师审核，科室主任核准签发后，方可备血；③同一患者一天申请备血量达到或超过1600毫升的，由具有中级以上专业技术职务任职资格的医师提出申请，科室主任核准签发后，报医务部门批准，方可备血。以上规定内容不适用于急救用血。